某男，8个月。近日因脾胃不和、痰食阻滞引发积滞，症见停食停乳、腹胀便秘、痰盛喘咳。治当消食导滞、祛痰通便，宜选用的成药是
A. 肥儿丸
B. 小儿化食丸
C. 小儿消食片
D. 一捻金
E. 健脾消食丸

正确答案：D。一捻金

解析：本题考查的是一捻金的功能。近日因脾胃不和、痰食阻滞引发积滞，症见停食停乳、腹胀便秘、痰盛喘咳。治当消食导滞、祛痰通便，宜选用的成药是一捻金（D对）。一捻金：【功能】消食导滞，祛痰通便。肥儿丸（A错）：【功能】健胃消积，驱虫。小儿化食丸（B错）：【功能】消食化滞，泻火通便。小儿消食片（C错）：【功能】消食化滞，健脾和胃。健脾消食丸（E错）：【功能】健脾，和胃，消食，化滞。